CO中毒患者抽搐频发治疗首选药物是
A. 地西泮
B. 地塞米松
C. 胞磷胆碱
D. 甘露醇
E. 血管扩张剂

正确答案：A。地西泮

解析：CO中毒临床表现：轻度中毒为头晕，头痛，耳鸣，肢体无力，恶心，呕吐等表现；中重度中毒患者表现为意识模糊，认知能力下降，四肢厥冷，口唇甲床苍白发绀，甚至出现昏迷抽搐，严重者可于短期内造成死亡。CO中毒导致四肢抽搐主要是因为其损伤脑中枢神经的表现。一般的抽搐急救的首选药品是地西泮，它主要起镇静和控制抽搐的作用（A对）；地塞米松是一种肾上腺皮质激素药，主要用于抗炎、抗过敏、免疫抑制、抗中毒和抗休克等（B错）；胞磷胆碱是一种核苷的衍生物，能增强上行网状结构激动系统的功能。临床用于颅脑手术和脑外伤引起的意识障碍（C错）；甘露醇本品用于治疗各种原因引起的脑水肿，降低颅内压，防止脑疝，也可有效降低眼内压，应用于其他降眼内压药无效时或眼内手术前准备（D错）；血管扩张剂是周围血管疾病中，用于治疗闭塞性和痉挛性疾病最为重要的一类临床用药（E错）。